药品的生产企业、经营企业、研究机构，未按照规定实施相应质量管理规范且逾期不改正的，应
A. 责令停产、停业整顿，并处五千元以上二万元以下的罚款
B. 处二万元以上十万元以下的罚款
C. 五年内不受理其申请，并处一万元以上三万元以下的罚款
D. 责令改正，给予警告，对单位并处三万元以上五万元以下的罚款
E. 给予降级、撤职、开除处分，并处三万元以下的罚款

正确答案：A。责令停产、停业整顿，并处五千元以上二万元以下的罚款

解析：本题考查违反药品监督管理规定的法律责任。药品的生产企业、经营企业、研究机构，未按照规定实施相应质量管理规范且逾期不改正的，应责令停产、停业整顿，并处十万元以上五十万元以下的罚款（A对）。根据《药品管理法》第一百二十六条规定，除另有规定的情形外，药品上市许可持有人、药品生产企业、药品经营企业、药物非临床安全性评价研究机构、药物临床试验机构等未遵守药品生产质量管理规范、药品经营质量管理规范、药物非临床研究质量管理规范、药物临床试验质量管理规范等的，责令限期改正，给予警告；逾期不改正的，处十万元以上五十万元以下的罚款；情节严重的，处五十万元以上二百万元以下的罚款，责令停产停业整顿直至吊销药品批准证明文件、药品生产许可证、药品经营许可证等，药物非临床安全性评价研究机构、药物临床试验机构等五年内不得开展药物非临床安全性评价研究、药物临床试验，对法定代表人、主要负责人、直接负责的主管人员和其他责任人员，没收违法行为发生期间自本单位所获收入，并处所获收入百分之十以上百分之五十以下的罚款，十年直至终身禁止从事药品生产经营等活动。